儿童苯丙酮尿症的初筛选用的检查是
A. 血TSH测定
B. 染色体核型分析
C. 尿三氯化铁试验
D. 尿蝶呤分析
E. 血浆氨基酸分析

正确答案：C。尿三氯化铁试验

解析：儿童苯丙酮尿症的初筛选用的检查是尿三氯化铁试验（C对）。本题提问的是初筛而不是确诊，确诊是用血浆氨基酸分析（E错）。血T3T4TSH是甲亢或甲减的确诊方法（A错）。染色体核型分析是唐氏综合症的确诊方法（B错）。尿蝶呤分析用于鉴定三种非典型苯丙酮尿症（D错）。